女，40岁。皮肤出血点及瘀斑、牙龈出血1周。查体：肝脾不大。血常规：Hb110g/L，WBC4.0×10⁹/L，Plt10×10⁹/L：骨髓细胞学检查：巨核细胞95个/2cm×2cm，产板型巨核细胞1个。最可能的诊断是
A. 急性白血病
B. 特发性血小板减少性紫癜
C. 再生障碍性贫血
D. 骨髓增生异常综合征
E. 巨幼细胞贫血

正确答案：B。特发性血小板减少性紫癜

解析：患者中年女性，皮肤出血点及瘀斑、牙龈出血1周（ITP患者因血小板减少可有皮肤黏膜出血，常表现为皮肤瘀点、瘀斑、鼻出血、牙龈出血），查体：肝脾不大（ITP患者一般无肝脾肿大），血常规：Hb110g/L（成年女性Hb正常值110～150g/L），WBC4.0×10⁹/L（正常4～10×10⁹/L），Plt10×10⁹/L（正常100～300×10⁹/L）明显减少，骨髓细胞学检查：巨核细胞95个/2cm×2cm，产板型巨核细胞1个（骨髓巨核细胞增加，产板型巨核细胞减少），提示骨髓巨核细胞发育成熟障碍，故患者最可能的诊断是特发性血小板减少性紫癜（ITP）。急性白血病（P571）（A错） 常表现为贫血、出血、感染、肝脾肿大等症状，白细胞常增多，骨髓原始细胞增多；再生障碍性贫血（P547-P548）（C错）常表现为贫血、出血、感染等症状，全血细胞减少，骨髓增生减低，粒、红系及巨核细胞均减少；骨髓增生异常综合征（P564）（D错）以病态造血为特征，表现为贫血、出血、感染等症状，可伴有一系或多系血细胞减少，无巨核细胞发育成熟障碍；巨幼细胞贫血（P545）（E错）主要表现为贫血，可有神经、精神症状，血红蛋白降低，叶酸或维生素B₁₂减少，骨髓增生活跃，红系增生显著、巨幼变，巨核细胞可有体积增大，分叶过多。